产后多长时间产妇应回分娩医院复查
A. 6周
B. 2月
C. 56天
D. 3月
E. 100天

正确答案：A。6周

解析：本题考查产后复查时间。孕妇产后6周（A对BCDE错）复查应回分娩医院复查，且是非常有必要的。从胎盘娩出至产妇全身各器官除乳腺外恢复至正常未孕状态所需要的一段时期，称为产褥期，通常为六周，即42天。